队列研究的主要偏倚是
A. 选择偏倚
B. 回忆偏倚
C. 测量偏倚
D. 失访偏倚
E. 随意误差

正确答案：D。失访偏倚

解析：本题考查队列研究的主要偏倚。由于队列研究是前瞻性研究，研究对象的随访是队列研究中一项十分艰巨和重要的工作，随访的对象、内容、方法、时间、随访者等都直接与研究工作的质量相关，因此，应事先计划、严格实施，因此队列研究的主要偏倚是失访偏倚（D对ABCE错）。